所谓一级预防是指
A. 早期发现
B. 临床预防
C. 病因预防
D. “三早”预防

正确答案：C。病因预防

解析：本题考查一级预防。所谓一级预防是指病因预防（C对ABD错），是在疾病（或伤害）尚未发生时针对病因或危险因素采取措施，降低有害暴露的水平，增强个体对抗有害暴露的能力，预防疾病（或伤害）的发生，或至少推迟疾病的发生。